患儿，3岁。近2天来因外出游玩，回来即见发热，哭闹不安，口颊、齿龈见多个溃疡，口臭流涎，舌质红，苔薄黄。其证候是
A. 心火上炎
B. 风热乘脾
C. 心脾积热
D. 虚火上浮
E. 肝胆湿热

正确答案：B。风热乘脾

解析：该题主要考查小儿口疮的辩证。小儿口疮，以齿酿、舌体、两颊、上颗等处出现黄白色溃疡，疼痛流涎，或伴发热为特征。风热乘脾起于外感风热之后，以起病急，多伴发热，溃疡点较多，周围锨红为特征。病初起，风热在表，多有发热恶寒;风热内侵脾胃，则口臭便秘;湿热偏重，则疮面色黄或糜烂。本病可单患儿，3岁。近2天来因外出游玩，回来即见发热，哭闹不安，口颊、齿龈见多个溃疡，口臭流涎，舌质红，苔薄黄。可判断为口疮风热乘脾（B对）。心火上炎：证候舌上、舌边溃疡，色赤疼痛，饮食困难，心烦不安，口干欲饮，小便短黄，舌尖红，苔薄黄，数，指纹紫（A错）。口疮证型中无心脾积热（C错）、无肝胆湿热（E错）。虚火上浮证候口腔溃疡或糜烂，周围色不红或微红，疼痛不甚，反复发作或迁延不愈，神疲颧红，口干不渴，舌红，苔少或花剥，脉细数，指纹淡紫（D错）。